女，28岁，诉妊娠4+月，昨搬重物后，腰酸，下坠感，今上午下腹始有阵痛，持续加重，半小时前阴道有流液，量较多，湿透内裤，急诊来院如确诊胎膜已破，此患者最适当处理是
A. 安胎
B. 刮宫
C. 用宫缩药物尽早使胚胎、胎盘组织排出
D. 抗炎
E. 输血

正确答案：C。用宫缩药物尽早使胚胎、胎盘组织排出

解析：难免流产一旦确诊，应尽早使胚胎及胎盘组织完全排出。早期流产应及时行负压吸宫术，对妊娠产物进行认真检查，并送病理检查。晚期流产，因子宫较大，吸宫或刮宫有困难者，可用缩宫素10单位加于5％葡萄糖液500ml内静脉滴注，促使子宫收缩。当胎儿及胎盘排出后需检查是否完全，必要时刮宫以清除宫腔内残留的妊娠产物。掌握“自然流产”知识点。